世界各地大部分恶性肿瘤的发病率和死亡率呈上升趋势，下列哪种因素不是造成该趋势的原因
A. 世界人口增加
B. 人口老龄化
C. 工业化进程加快
D. 生态环境的改变

正确答案：A。世界人口增加

解析：本题考查恶性肿瘤高发的原因。引起恶性肿瘤高发的原因包括：①人口老龄化（B对）；②工业化进程加快（C对）；③生态环境恶化（D对）。世界人口增加（A错，为本题正确答案）不是恶性肿瘤高发的原因。